某单位职工，男性，48岁。平时性情怪异，与同事相处甚难，某同事想让其就诊心理咨询，但该职工坚决反对，心理医师也不主张这样的人来门诊治疗，是因为心理治疗的性质有
A. 学习性
B. 自主性
C. 实效性
D. 应用性
E. 操作性

正确答案：B。自主性

解析：旧版教材中，心理治疗的性质有自主性、学习性和实效性。自主性：心理治疗的关键是帮助病人自己改变自己。题中职工反对心理治疗，因而心理医师的建议是符合自主性（B对）。学习性：心理治疗的过程就是一个学习的过程（A错）。实效性：心理治疗师是一项有实效的工作，它是有效的、有益的，而且是人道的（C错）。应用性（D错）和操作性（E错）不是心理治疗的性质。